以下关于龋病的描述中，错误的是
A. 龋病是一种感染性疾病
B. 牙硬组织脱矿
C. 有机物的不断分解
D. 主要在细菌的作用下产生的
E. 牙硬组织快速破坏性的一种疾病

正确答案：E。牙硬组织快速破坏性的一种疾病

解析：龋是一种牙硬组织的感染性疾病，是由于细菌作用，牙硬组织脱矿、有机物分解，从而造成牙硬组织发生慢性进行性破坏的一种疾病。掌握“牙釉质龋”知识点。